对原发性三叉神经痛均应首先采用的治疗是
A. 药物治疗
B. 半月神经节射频温控热凝术
C. 针刺疗法
D. 封闭疗法
E. 手术疗法

正确答案：A。药物治疗

解析：对原发性三叉神经痛均应首先采用药物治疗，如无效时再考虑其他方法。掌握“三叉神经痛”知识点。